下列关于生理性带下的描述，错误的是
A. 色白或无色透明
B. 质地粘稠
C. 其量适中
D. 无特殊气味
E. 从阴道内排出的一种阴液

正确答案：B。质地粘稠

解析：带下量多，色黄或脓性，质粘稠多为病理性湿热下注型带下过多疾病，故不属于生理性带下（B对）。生理性带下属于妇女体内的一种阴液，是由胞宫渗润于阴道的色白或透明，无特殊气味的黏液，其量不多。而质地粘稠为病理性带下（ACDE错）。